硫酸镁静脉注射用于
A. 颅内压升高与青光眼
B. 妊娠高血压
C. 急性皮炎
D. 经尿道行前列腺切除术
E. 慢性胆囊炎

正确答案：B。妊娠高血压

解析：本题考查硫酸镁。硫酸镁静脉注射用于妊娠高血压（B对）。硫酸镁注射液主要用于抗惊厥的治疗,用于妊娠期高血压的患者可以治疗子痫以及先兆子痫。